骨密质主要分布于
A. 跟骨
B. 椎骨
C. 骺端
D. 长骨骨干
E. 髂骨

正确答案：D。长骨骨干

解析：骨密质主要分布于长骨骨干表面（D对）。